治疗阴虚发热，应首选
A. 六味地黄丸
B. 一贯煎
C. 清骨散
D. 二阴煎
E. 三圣散

正确答案：C。清骨散

解析：阴虚发热，其机理是阴虚阳盛，虚火内炽，治疗应以滋阴清热为法，方用清骨散（C对）清虚热、退骨蒸。六味地黄丸有填精滋阴补肾的作用，主治肾阴精不足证（A错）。一贯煎有养阴益胃、和中止痛的作用，可用于治疗胁痛之肝络失养证（B错）清虚热、退骨蒸。二阴煎为狂证火胜伤阴的代表方，重在滋阴降火，安神宁心（D错）。三圣散功用为涌吐风痰；主治中风闭证，癫病，误食毒物，停于上脘者（E错）。